2015年6月25日，国家食品药品监督管理总局发布《关于停止生产销售使用酮康唑口服制剂的公告》（2015年85号），决定即日起停止酮康唑口服制剂在我国的生产、销售和使用，撤销药品批准文号。如果药品零售企业继续销售酮康唑片，药品监督管理部门应该
A. 销售劣药罪
B. 未按照实施《药品经营质量管理规范》处理
C. 销售假药罪
D. 无证经营罪

正确答案：C。销售假药罪

解析：本题考查药品安全法律。无药品批准文号，酮康唑按假药论处，如果药品零售企业继续销售酮康唑片，为销售假药罪（C对）。